绿地率是反映城市绿化水平的基本指标，绿地率新区建设应不低于
A. 0.3
B. 0.25
C. 0.2
D. 0.15
E. 0.4

正确答案：A。0.3

解析：本题考查绿地率。绿地率指城市一定地区内各类绿化用地总面积占该地区总面积的比例。绿地率新区建设应不低于30%（A对BCDE错）；旧区改建不宜低于25%。